参与构成距小腿(踝)关节的结构为
A. 胫、腓骨的下端和距骨滑车
B. 胫、腓骨的下端和距骨头
C. 胫骨下端和跖骨头
D. 胫、腓骨的下端和跟骨结节
E. 腓骨下端和距骨滑车

正确答案：A。胫、腓骨的下端和距骨滑车

解析：参与构成距小腿关节的结构有：胫、腓骨下端和距骨滑车（A对）。